诊断室性心动过速最重要的依据是
A. R-R间期规整
B. QRS波群宽大畸形
C. 频率100～250次/分
D. 心室夺获与室性融合波
E. T波与QRS波主波方向相反

正确答案：D。心室夺获与室性融合波

解析：室性心动过速发作时少数室上性冲动可下传心室，产生心室夺获，表现为在P波之后，提前发生一次正常的QRS波。当室性心动过速产生的冲动与窦房结下传的冲动同时激动心室的一部分时，可产生室性融合波（D对）。因此诊断室性心动过速最重要的依据是心室夺获与室性融合波。R-R间期规整（A错）仅表示心室率节律整齐，可见于多种心律失常，无特异性。QRS宽大畸形（B错）可见于室性期前收缩，也可见于室上性心动过速伴差异性传导等。阵发性室上性心动过速（P192）的心率多为150～250次/分，心房颤动（P188）的心室率通常在100～160次/分，故频率100～250次/分（C错）并不是诊断室性心动过速最重要的依据。T波与QRS波主波方向相反（E错）也可见于室性心动过速（P198），但并非最重要的依据。